IQ=15（X-M）/S+100智商是指
A. 晶体智商
B. 混合智商
C. 比率智商
D. 离差智商
E. 液体智商

正确答案：D。离差智商

解析：离差智商的计算公式为：IQ=100+15（X-M）/S。掌握“常用的心理测验及临床评定测量表”知识点。